前囟的正确测量方法是
A. 临边中点连线
B. 邻角顶点连线
C. 对边中点连线
D. 周径长度
E. 对角顶点连线

正确答案：C。对边中点连线

解析：前囟的正确测量方法是对边中点连线（C对）。前囟检查在儿科临床很重要，如脑发育不良时头围小、前囟小或关闭早，甲状腺功能减退时闭合延迟，颅内压增高时前囟饱满，脱水时前囟凹陷。